吸毒的社会根源不包括
A. 毒品的可获得性
B. 同伴影响和团伙压力
C. 自身好奇心强
D. 成长环境的影响
E. 社会文化对毒品的容忍程度

正确答案：C。自身好奇心强

解析：本题考查吸毒的社会根源。①毒品的可获得性（A对）；②同伴影响和团伙压力（B对）；③成长环境的影响（D对）；④社会文化对毒品的容忍程度（E对）。自身好奇心强（C错，为本题正确答案）不属于吸毒的社会根源。